艾附暖宫丸除调经外又能
A. 养血安神
B. 健脾益气
C. 理气养血
D. 疏肝健脾

正确答案：C。理气养血

解析：本题考查艾附暖宫丸的功能。艾附暖宫丸除调经外又能理气养血（C对）。艾附暖宫丸【功能】理气养血，暖宫调经。坤宝丸【功能】滋补肝肾，养血安神（A错）。止泻灵颗粒【功能】健脾益气（B错），渗湿止泻。逍遥颗粒（丸）【功能】疏肝健脾（D错），养血调经。白带丸【功能】清热，除湿，止带（E错）。